酸碱滴定法使用的指示剂是
A. 酚酞
B. 淀粉
C. 荧光黄
D. 邻二氮菲
E. 铬黑T

正确答案：A。酚酞

解析：本题考查酸碱滴定法。酸碱滴定法使用的指示剂是酚酞（A对）。酸碱滴定法是利用酸和碱在水中以质子转移反应为基础的滴定分析方法。可用于测定酸、碱和两性物质。酸碱指示剂包括甲基橙、酚酞等。淀粉（B错）是碘滴定法的指示剂。荧光黄（C错）是溶液沉淀法的指示剂。邻二氮菲（D错）是铈量法的指示剂。铬黑T（E错）是EDTA滴定法的指示剂。